有关牵涉性痛何者错误？
A. 心绞痛时，常在心前区及左臂内侧皮肤感到疼痛
B. 肾脏疾患时，常在肾区感到疼痛
C. 肝胆疾患时，常在左肩部感到疼痛
D. 牵涉性痛，可发生在距患病内脏较远的皮肤区
E. 某些内脏器官病变时，在体表—定区域产生感觉过敏或疼痛

正确答案：C。肝胆疾患时，常在左肩部感到疼痛

解析：肝胆疾患时，常在右肩部感到疼痛（C错，为本题正确选项）。心绞痛时，常在心前区及左臂内侧皮肤感到疼痛（A对）。肾脏疾患时，常在肾区感到疼痛（B对）。牵涉性痛，可发生在距患病内脏较远的皮肤区（D对）。.某些内脏器官病变时，在体表—定区域产生感觉过敏或疼痛（E对）。